下列除哪项外，常可引起肝细胞性黄疸
A. 疟疾
B. 急性甲型肝炎
C. 中毒性肝炎
D. 钩端螺旋体病
E. 肝癌

正确答案：A。疟疾

解析：引起黄疸的原因包括溶血性黄疸、肝细胞性黄疸、胆汁淤积性黄疸、先天性非溶血性黄疸。肝细胞性黄疸多由各种肝细胞严重损害的疾病引起，如急性甲型肝炎（B对）、中毒性肝炎（C对）、钩端螺旋体病（D对）、肝癌（E对）等。疟疾（A错，为本题正确答案），恶性疟疾时，红细胞大量破坏，发生DIC,可出现溶血性黄疸。